冬葵子除润肠通便外，又能
A. 下乳
B. 补虚
C. 清肺化痰
D. 凉血止血
E. 燥湿化痰

正确答案：A。下乳

解析：本题考查的是冬葵子的功效。冬葵子除润肠通便外，又能下乳（A对）。冬葵子：【功效】利水通淋，下乳，润肠通便。仙鹤草：【功效】收敛止血，止痢，截疟，解毒，杀虫，补虚（B错）。瓜蒌：【功效】清肺润燥化痰（C错），利气宽胸，消肿散结，润肠通便。石韦：【功效】利尿通淋，凉血止血（D错），清肺止咳。陈皮：【功效】理气调中，燥湿化痰（E错）。